胚胎第六周，侧舌隆突与以下哪个部分联合发育成舌体
A. 球状突
B. 舌隆突
C. 奇结节
D. 上颌突
E. 下颌突

正确答案：C。奇结节

解析：在胚胎第6周，侧舌隆突互相联合，并与奇结节联合发育成舌体。掌握“腭部与舌的发育”知识点。